谷类食品淀粉全部集中在
A. 胚
B. 胚乳
C. 谷皮
D. 全谷粒
E. 糊粉层

正确答案：B。胚乳

解析：《营养与食品卫生学》第八版P143
胚乳是谷类的主要部分，含大量淀粉